下列按假药论处的药品是
A. 未标明有效期的
B. 不注明生产批号的
C. 所标明的适应症超出规定范围的
D. 所标明的功能主治超出规定范围的
E. 依法必须检验而未经检验即销售的

正确答案：C、D、E。所标明的适应症超出规定范围的；所标明的功能主治超出规定范围的；依法必须检验而未经检验即销售的

解析：本题考查假药。《中华人民共和国药品管理法》规定，有下列情形之一的药品，按假药论处：1.国务院药品监督管理部门规定禁止使用的；2.依照本法必须批准而未经批准生产、进口，或者依照本法必须检验而未经检验即销售的（E对）；3.变质的；4.被污染的；5.使用依照本法必须取得批准文号而未取得批准文号的原料药生产的；6.所标明的适应症（C对）或者功能主治（D对）超出规定范围的。未标明有效期（A错）、不注明生产批号（B错）的按劣药论处。